男，46岁，因心悸胸痛劳力性呼吸困难数日就诊。心电图示左室肥大，Ⅱ、Ⅲ、aVL、aVF导联有病理性Q波。心导管检查示左室腔与流出道间压差＞20mmHg，Brockenbrough现象阳性。诊断是
A. 扩张型心肌病
B. 肥厚型心肌病
C. 限制型心肌病
D. 未定型心肌病
E. 特异性心肌病

正确答案：B。肥厚型心肌病

解析：患者中年男性，有心悸、胸痛、劳力性呼吸困难，Ⅱ、Ⅲ、aVL、aVF导联有病理性Q波（少数肥厚型心肌病可出现），心导管检查示左室腔与流出道间压差＞20mmHg，Brockenbrough现象阳性（指在有完全代偿间歇的室性期前收缩时，期前收缩后的心搏增强，心室内压上升，但同时由于收缩力增强梗阻亦加重，所以主动脉内压反而降低的现象这是肥厚型梗阻性心肌病心导管检查出现的特征性表现），因此该患者考虑诊断为肥厚型心肌病（B对）。扩张型心肌病（P261）（A错）以左心室或双心室扩张为主，病理性Q波少见，不会出现Brockenbrough现象阳性。限制型心肌病（P269）（C错）的特点为单侧或双侧心室充盈受限和舒张容量下降，多伴心室肥厚和双心房扩大。未定型心肌病（D错）是扩张型、肥厚型、限制型致心律失常型以外的心肌病，其表现复杂多变。特异型心肌病（E错）是继发性心肌病，多有原发病表现及诱发因素。